男，38岁。突然呕血1天。呕吐物为血混有食物，共4次，每次约100ml，伴头晕。既往消化性溃疡病史6年。査体：P100次/分，BP100/70mmHg，贫血貌，巩膜无黄染，腹平软，无压痛，未触及包块，腹水征（-）。临床确定出血部位应特别注意检查
A. 贲门部和十二指肠前壁
B. 胃底部和十二指肠球后部
C. 胃小弯和十二指肠后壁
D. 幽门和十二指肠前壁
E. 胃大弯和十二指肠侧壁

正确答案：C。胃小弯和十二指肠后壁

解析：青年男性患者，突发呕血，呕吐物为血，混有食物（提示上消化道出血），既往消化性溃疡病史，结合患者病史和体查，应考虑为消化性溃疡大出血。胃溃疡出血的主要部位是胃小弯，十二指肠溃疡出血的主要部位是后壁，因此确定出血部位应特别注意检查胃小弯和十二指肠后壁（C对）。